疾病依照规律性的时间间隔发生流行
A. 季节性
B. 周期性
C. 短期波动
D. 遗传性
E. 长期变异

正确答案：B。周期性

解析：周期性：即疾病依照规律性的时间间隔发生流行。掌握“流行病学资料与疾病分布”知识点。